能翻转肾上腺素升压作用的药物是
A. M受体阻断药
B. N受体阻断药
C. β受体阻断药
D. α受体阻断药
E. H₁受体阻断药

正确答案：D。α受体阻断药